质量调整生存年（即：健康寿命年）可以综合反映人群的
A. 健康状态和疾病频率
B. 生命质量和生存数量
C. 潜在危险因素和疾病频率
D. 个人社会网络和社会联系
E. 健康危险因素和期望寿命

正确答案：B。生命质量和生存数量